甘露醇临床应用不包括
A. 脑水肿
B. 高尿酸血症
C. 急性肾衰竭
D. 降低眼内压
E. 青光眼急性发作

正确答案：B。高尿酸血症

解析：甘露醇临床应用：①甘露醇是治疗脑水肿、降低颅内压安全而有效的首选药物。也可用于青光眼急性发作和患者术前应用以降低眼内压。②可用于预防急性肾衰竭。在少尿时，通过脱水作用，可减轻肾间质水肿。同时渗透性利尿效应可维持足够的尿量，稀释肾小管内有害物质。对肾衰竭伴有低血压者效果较好。掌握“保钾利尿药和渗透性利尿药”知识点。